易感者通过接触了被污染的医疗设备、器械和日常生活用品而造成的传播
A. 直接接触传播
B. 间接接触传播
C. 飞沫传播
D. 空气传播
E. 性传播

正确答案：B。间接接触传播

解析：间接接触：即易感者通过接触了被污染的医疗设备、器械和日常生活用品而造成的传播。最常见的是病原微生物从感染源经由医护人员污染的手传给新宿主。此外，污染而未消毒的印模、模型等也可造成感染。牙椅冷光源把手以及升降开关等使用频率高、污染严重，其消毒灭菌常被忽视和遗忘，也会形成间接传染源。其他如水龙头、电器开关、抽屉把手、病历、用于记录的笔等都有可能成为传播媒介。其中危害性最大的当属消毒与灭菌不当的口腔器械设备。掌握“口腔医疗保健中的感染”知识点。